革兰阳性细菌败血症很少表现为
A. 稽留热
B. 转移性脓肿
C. 寒战
D. 皮疹
E. 昏迷

正确答案：E。昏迷

解析：革兰阳性细菌败血症，以金葡菌败血症为代表，主要表现为寒战（C对）、高热（稽留热或弛张热）（A对）、皮疹（D对）、转移性脓肿（B对）等，昏迷、感染性休克较少见（E错，为本题正确答案）。